属于乳腺癌发病高危因素的是
A. 初潮14岁
B. 52岁绝经
C. 26岁头胎初产
D. 生育3胎子女
E. 母亲患乳腺癌

正确答案：E。母亲患乳腺癌